面部贯通伤，皮肤黏膜，如果缺损较大，怎么处理
A. 严密缝合口腔黏膜
B. 严密缝合颊部皮肤
C. 黏膜、肌、皮肤逐层缝合
D. 定向拉拢缝合
E. 将皮肤与黏膜缝合

正确答案：E。将皮肤与黏膜缝合

解析：本题考查口腔颌面部各类软组织损伤的处理特点。面部贯通伤，皮肤黏膜，如果缺损较大，应将皮肤与黏膜缝合（E对）。颊部贯通伤的治疗原则是尽量关闭创口和消灭创面。1.无组织缺损或缺损较少者，可将口腔黏膜、肌肉和皮肤分层缝合（C错）。2.口腔黏膜无缺损或缺损较少而皮肤缺损较大者，应严密缝合口腔创口（A错），隔绝与口腔相通。颊部皮肤缺损可行皮瓣转移或游离皮瓣修复，或作定向拉拢缝合（D错），遗留的缺损待后期修复。3.较大的面颊部全层洞穿型缺损，可直接将创缘的口腔黏膜与皮肤相对缝合，消灭创面。遗留的洞穿缺损待后期进行修复。但伤情条件允许时，也可在清创后用带蒂皮瓣、吻合血管的游离皮瓣及植皮术早期修复洞穿缺损（B错）。